长期吞咽受阻，饮食不下，面色㿠白，精神疲惫，形寒气短，面浮足肿，泛吐清涎，腹胀便溏，舌淡苔白，脉细弱，诊为
A. 脾胃虚弱型呕吐
B. 中虚有寒型反胃
C. 脾阳虚衰型水肿
D. 胃阴不足型呕吐
E. 气虚阳微型噎膈

正确答案：E。气虚阳微型噎膈

解析：根据“长期吞咽受阻，饮食不下”，可知病为“噎膈”；根据“面色㿠白，精神疲惫，形寒气短，面浮足肿，泛吐清涎，腹胀便溏，舌淡苔白，脉细弱”，可辨为“气虚阳微证”（E对）。中虚有寒型呕吐的临床表现为饮食稍多即欲呕吐，时发时止，食入难化，不思饮食，面色晄白，倦怠乏力，四肢不温，大便稀溏等。与题干证型相似但病位不同，呕吐病位在胃脘部，噎膈病位在食管（A错）。脾胃虚寒型反胃的临床表现为食后脘腹胀满，朝食暮吐，暮食朝吐，宿谷不化，吐后则舒，神疲乏力，面色清白，手足不温等（B错）。脾阳虚衰型水肿的临床表现为身肿日久，腰以下为甚，按之凹陷不易恢复，脘腹胀闷，纳减便溏，面色不华，神疲乏力，小便短少等（C错）。胃阴不足型呕吐临床表现为呕吐反复发作，或时作干呕，恶心，胃中嘈杂，似饥而不欲食，口燥咽干等（D错）。